发热患者最常出现
A. 代谢性酸中毒
B. 呼吸性酸中毒
C. 混合性酸中毒
D. 代谢性碱中毒
E. 混合性碱中毒

正确答案：A。代谢性酸中毒

解析：发热患者在体温上升期易出现寒战，寒战时肌肉活动量加大，对氧的需求大幅度增加，此时肌肉活动所需的能量大部分依赖无氧代谢供给，因而产生大量乳酸，易引起代谢性酸中毒（A对）。呼吸性酸中毒（B错）、混合性酸中毒（C错）、代谢性碱中毒（D错）、混合性碱中毒（E错）都不是发热患者最常出现的酸碱失衡类型。